患者泄泻腹痛，泻下急迫，粪色黄褐，气味臭秽，肛门灼热，烦热口渴，舌质红，苔黄腻，脉滑数。治疗应首选
A. 藿香正气散
B. 不换金正气散
C. 葛根芩连汤
D. 白头翁汤
E. 芍药汤

正确答案：C。葛根芩连汤

解析：藿香正气散为泄泻寒湿内盛证的选方，亦可用于暑天感寒湿而痢者，功能解表散寒化湿，理气和中（A错）。不换金正气散为痢疾寒湿痢的选方，功能燥湿运脾（B错）。题中患者以泄泻腹痛，泻下急迫，粪色黄褐，气味臭秽为主症，无里急后重感，无赤白脓血，故诊断为泄泻。泄泻腹痛为感受湿热之邪，肠腑传化失常所致，肠中有热，热邪类火，火性急迫，故泻下急迫，湿热下注故粪色黄褐，气味臭秽，肛门灼热。烦热口渴，舌质红，苔黄腻，脉滑数为湿热内盛之象，故辨为湿热伤中证，治宜清热燥湿，分利止泻，方选葛根芩连汤（C对）。白头翁汤常合芍药汤治疗痢疾疫毒痢，功能清热凉血解毒（D错）。芍药汤为痢疾湿热痢的选方，功能调气行血，清热解毒（E错）。